以维护病患者和公众的健康利益为最高行为准则，是
A. 执业药师的责任
B. 执业药师的权力
C. 执业药师的义务
D. 执业药师的权利
E. 执业药师的执业行为规范

正确答案：E。执业药师的执业行为规范